胚乳中含量最高的营养成分是
A. 脂肪
B. 蛋白质
C. 无机盐
D. 维生素
E. 碳水化合物

正确答案：E。碳水化合物